治疗闭角型青光眼应选择
A. 新斯的明
B. 去甲肾上腺素
C. 加兰他敏
D. 阿托品
E. 毛果芸香碱

正确答案：E。毛果芸香碱

解析：本题考查毛果芸香碱的临床应用。治疗闭角型青光眼应选择毛果芸香碱（E对）。闭角型青光眼（急性或慢性充血性青光眼）患者的前房角狭窄、房水回流受阻，因而眼内压升高，毛果芸香碱滴眼后易透过角膜进入眼房，可使眼内压降低，从而缓解或消除青光眼症状。1.毛果芸香碱的临床应用：青光眼、虹膜睫状体炎、口腔干燥、抗胆碱药阿托品中毒的解救等。2.新斯的明（A错）用于治疗重症肌无力及腹部手术后的肠麻痹；尚可用于阵发性室上性心动过速和对抗竞争性神经肌肉阻滞药过量时的毒性反应。3.去甲肾上腺素（B错）仅限于早期神经源性休克以及嗜铬细胞瘤切除后或药物中毒时的低血压。本药稀释后口服，可使食管和胃黏膜血管收缩，产生局部止血作用。4.加兰他敏（C错）用于重症肌无力、进行性肌营养不良、脊髓灰质炎后遗症、儿童脑型麻痹、因神经系统疾患所致感觉或运动障碍、多发性神经炎等。5.阿托品（D错）的临床应用：解除平滑肌痉挛、抑制腺体分泌、虹膜睫状体炎、验光及眼底检查、缓慢型心律失常、抗休克、解救有机磷酸酯类中毒等。